主含士的宁的有毒中药是
A. 川乌
B. 半夏
C. 雷公藤
D. 马钱子
E. 黄药子

正确答案：D。马钱子

解析：本题考查的是马钱子及含马钱子中成药的中毒机制。主含士的宁的有毒中药是马钱子（D对）。马钱子及含马钱子中成药的中毒机制：马钱子含番木鳖碱即士的宁，毒性大。成人服用5～10mg即可中毒，一次服用30mg即可致死。番木鳖碱首先兴奋中枢神经系统，引起脊髓强直性痉挛，继而兴奋呼吸中枢及血管运动中枢。川乌（A错）的中毒机制：乌头类中药的主要有毒成分为乌头碱，一般中毒量为0.2mg，致死量为2～4mg。其毒性主要作用于神经系统，尤其是迷走神经等，使其先兴奋后抑制，并可直接作用于心脏，产生异常兴奋，可致心律失常，甚至引起室颤而死亡。半夏（B错）有毒，内服一般炮制后使用，3～9g。外用适量，磨汁涂或研末以酒调敷患处。不宜与川乌、制川乌、草乌、制草乌、附子同用；生品内服宜慎。雷公藤（C错）的主要毒性物质为雷公藤甲素与雷公藤醋酸乙酯。黄药子（E错）毒性与薯蓣皂苷、薯蓣毒皂苷、二萜内酯类成分如黄独乙素、黄酮类和皂苷类等有关。